大肠的主要的功能是
A. 吸收水分和无机盐
B. 食物残渣的储存场所
C. 将食物残渣转变为粪便
D. 每日内容物为1000ml
E. 仅有约150ml的水随粪便排出

正确答案：A。吸收水分和无机盐